取头、面、胸、腹部腧穴最适宜选用
A. 仰卧位
B. 俯卧位
C. 侧卧位
D. 伏俯坐位
E. 侧伏坐位

正确答案：A。仰卧位

解析：取头、面、胸、腹部腧穴应选择仰卧位（A对）。